自闭症属于
A. 学业相关问题
B. 情绪问题
C. 品行问题
D. 顽固性不良习惯
E. 广泛性发育障碍

正确答案：E。广泛性发育障碍